女，53岁。寒战高热1周，少量脓血痰。查体：T39.4摄氏度，右下肺散在湿啰音，胸部X线片示右下肺叶实变阴影伴小空洞形成，血WBC15.3×10⁹/L，N0.96。该患者感染的病原菌最可能是
A. 结核分枝杆菌
B. 肺炎链球菌
C. 铜绿假单胞菌
D. 金黄色葡萄球菌
E. 流感嗜血杆菌

正确答案：D。金黄色葡萄球菌

解析：患者为中老年女性，出现寒战高热和脓血痰（金黄色葡萄球菌肺炎的特征性痰液），体温超过39℃，肺内出现湿啰音，血中白细胞和中性粒细胞升高（白细胞正常值4～10×10⁹/L，中性粒细胞正常比例50%～70%），其肺部X线影像为实变阴影伴小空洞形成，根据其临床表现和辅助检查，符合金黄色葡萄球菌感染（D对）。结核分枝杆菌（A错）引起的结核病症状一般为咳嗽，咳痰，痰中带血，多发生午后潮热，血常规中常出现淋巴细胞增多，中性粒细胞升高，寒战高热，脓血痰，中性粒细胞升高较为少见。肺炎链球菌（B错）引起的肺炎链球菌性肺炎一般起病急骤，有高热、寒战的症状，痰少，可带血或呈铁锈色，白细胞升高，中性粒细胞比例升高，但其X线常见表现为肺叶和肺段浸润实变影，可见支气管充气征，肋膈角可有少量胸腔积液，与患者肺部X线影像不符。铜绿假单胞菌（C错）感染毒血症症状明显，痰可呈蓝绿色，X线表现常出现弥慢性支气管炎，早期可出现肺脓肿，多为小脓肿，不符合本题中患者症状及X线表现。流感嗜血杆菌（E错）引起的肺炎多见于小儿，症状常表现为发热，咳嗽，咳脓性痰，呼吸急促，发绀，与一般的肺炎类似，X线表现常呈肺实变与病变融合，组织坏死后容易形成多发性肺脓肿，常见双肺下叶受累，其典型X线表现与患者X线表现不符。